窝洞制备时洞缘曲线要求圆钝，其目的是
A. 防止牙齿折裂
B. 防止充填体折裂
C. 防止充填体脱落
D. 防止继发龋发生
E. 防止充填材料的刺激

正确答案：A。防止牙齿折裂

解析：本题考查窝洞制备时洞缘曲线要求圆钝的目的。圆缓的外形避免应力集中从而防止牙齿折裂（A对）。防止充填体折裂应制备有一定深度的洞形，保证充填体的厚度（B错）。防止充填体脱落应制备固位形，使用粘接技术增加固位力（C错）。防止继发龋发生应去净龋坏组织，严密充填以防止微渗漏（D错）。防止充填材料的刺激，应对深窝洞进行垫底处理或使用刺激性小的材料（E错）。